患者，男，40岁。素有高血压病史，现眩晕耳鸣，面红头胀，腰膝酸软，失眠多梦，时有遗精或性欲亢进，舌红，脉沉弦细，其病机是
A. 阴虚内热
B. 阴损及阳
C. 阴虚阳亢
D. 阳损及阴
E. 阴虚火旺

正确答案：C。阴虚阳亢

解析：阴虚指精血或津液的亏虚。一般在正常状态下，阴和阳是相对平衡的，相互制约而协调。阴气亏损，阳气失去制约，就会产生亢盛的病理变化，生理病理性功能亢进，称为“阳亢”。因此，阴虚会引起阳气亢盛，阳亢则能使阴液耗损，两者互为因果。临床表现为潮热，颧红，盗汗，五心烦热，咳血，视物不清，消瘦或失眠，麻木拘急，烦躁易思，或遗精，性欲亢进，舌红而干等。高血压和糖尿病等均可有阴虚阳亢表现。该患者素有高血压史，眩晕耳鸣，面红头胀，为肝阳上亢之象，而舌红脉弦细，腰膝酸软，失眠多梦为肾阴虚之象，综上所述诊为肾阴不足不能制亢肝阳，为阴虚阳亢（C对）。